医师张某给一患者开具了处方，患者取药时，药剂师指出该处方不符合相关规定不予调配。其理由是
A. 该处方使用了药品通用名称
B. 该处方同时开具了中成药和西药?
C. 该处方开具了5种药物
D. 该处方注明了5天有效期
E. 该处方开具了7天药物用量

正确答案：D。该处方注明了5天有效期

解析：处方开具当日有效，特殊情况需要延长有效期的，由开具处方的医师注明有效期限，但有效期最长不得超过3天。本题中医师张某开具处方注明5天有效期（D对），不符合规定。药品名称应当使用规范的中文名称书写，没有中文名称的可以使用规范的英文名称书写（P231）。通用名称是药品的法定名称，该处方使用了药品通用名称（A错），符合规定。西药和中成药可以分别开具处方，也可以开具一张处方，中药饮片应当单独开具处方（P231），该处方同时开具了中成药和西药（B错），符合规定。开具西药、中成药处方，每一种药品应当另起一行，每张处方不得超过5种药品（P231），该处方开具了5种药物（C错），符合规定。处方一般不得超过7日用量（P232），该处方开具了7天药物用量（E错），符合规定。